休克抑制期的病理生理改变主要是
A. 微动脉及毛细血管前括约肌舒张，毛细血管后的小静脉处在收缩期
B. 细胞内的溶酶体膜破裂，造成细胞自溶
C. 肾上腺髓质和交感神经节后纤维释放大量儿茶酚胺
D. 细胞能量来源主要是糖酵解
E. 毛细血管内有微细血栓形成

正确答案：A。微动脉及毛细血管前括约肌舒张，毛细血管后的小静脉处在收缩期

解析：休克的病理变化主要为微循环收缩期、微循环扩张期、微循环衰竭期。微循环扩张期：由于组织细胞缺氧，乳酸增多，微动脉和毛细血管前括约肌麻痹扩张，而小静脉仍处收缩状态（A对），真毛细血管网瘀血，静脉压增高，血浆外渗、血液浓缩、血流缓慢，此时休克加重进入抑制期。微循环收缩期：由于有效循环血量急剧减少，兴奋交感-肾上腺髓质系统，释放大量儿茶酚胺（C错），外周血管包括微动脉和毛细血管前括约肌强烈收缩，血液经动静脉短路和直接通路回流心脏，代偿性增加生命器官的供血，而真毛细血管网血流大大减少，使全身大多数的组织缺氧，将发生无氧糖酵解（D错）。微循环衰竭期：随着血流缓慢和酸中毒加重，毛细血管内血液黏稠度不断增加，血细胞和血小板凝集，微血栓形成（E错），弥漫性血管内凝血，一方面引起组织细胞缺氧进一步加重，导致细胞内的溶酶体膜破裂，致使多种酸性水解酶溢出，从而造成细胞自溶（B错），组织坏死及器官功能受损。